患者，男，50岁。反复上腹痛15年，腹痛常在饭后持续1～2小时。近半年疼痛加剧，食欲减退，体重减轻。检查：贫血貌，左锁骨上触及肿大淋巴结，血沉46mm/小时，大便隐血试验持续阳性。应首先考虑的是：
A. 慢性胆囊炎发作
B. 十二指肠溃疡发作
C. 胃溃疡伴幽门梗阻
D. 胃溃疡恶变
E. 复合性溃疡病

正确答案：D。胃溃疡恶变

解析：本例患者为中年男性，有反复上腹痛，餐后痛病史，符合胃溃疡的特点，近半年出现疼痛加剧，食欲减退，体重减轻（胃溃疡恶变常见的临床表现），查体可见贫血、左锁骨上可扪及肿大的淋巴结，血沉46mm/小时（正常值0～15mm/小时，血沉加快），大便隐血试验持续阳性提示胃肠道有长期小量出血，故诊断首先考虑的是胃溃疡恶变（D对）。慢性胆囊炎发作（A错）主要表现为阵发性右上腹绞痛，疼痛可放射至右肩、肩胛和背部，查体可有胆囊点压痛和墨菲氏征阳性。十二指肠溃疡发作（B错）主要表现为腹痛，饥饿时加重，进餐后缓解，一般不会出现贫血貌和淋巴结肿大。胃溃疡伴幽门梗阻（C错）主要表现为腹痛，进餐后加重、呕吐宿食，查体可发现胃蠕动波和震水声。复合性溃疡病（E错）指胃和十二指肠均有活动性溃疡，多见于男性，主要表现为腹痛，幽门梗阻发生率较高。